20多岁的女性，发热乏力两周，既往月经增多2年，入院后查三系都低，MCV70，问不会有什么症状
A. 皮肤干燥
B. 共济失调和行动不稳
C. 烦躁易怒
D. 异食癖
E. 口腔炎

正确答案：B。共济失调和行动不稳

解析：患者女，20多岁，发热乏力两周，既往月经增多2年（缺铁性贫血的病因），入院后查三系都低，MCV70，结合患者的表现，提示为缺铁性贫血，可出现精神行为异常，如烦躁、易怒（C对）、注意力不集中、异食癖（D对）；体力、耐力下降；易感染；儿童生长发育迟缓、智力低下；口腔炎（E对）、舌炎、舌乳头萎缩、吞咽困难；毛发千枯、脱落；皮肤干燥（A对）、皱缩；指（趾）甲缺乏光泽、脆薄易裂，重者指（趾）甲变平，甚至凹下呈勺状（匙状甲）等表现，共济失调或步态不稳是巨幼细胞贫血的表现（B错，为本题的正确答案）。